以下哪项属于化脓性骨髓炎
A. 慢性弥漫性硬化性骨髓炎
B. 婴幼儿颌骨骨髓炎
C. Garré骨髓炎
D. 颌骨放射性骨坏死
E. 特异性骨髓炎

正确答案：B。婴幼儿颌骨骨髓炎

解析：本题考查颌骨骨髓炎。以下婴幼儿颌骨骨髓炎（B对）属于化脓性骨髓炎。颌骨骨髓炎可分为急性、慢性颌骨骨髓炎或化脓性、非化脓性颌骨骨髓炎。其中化脓性颌骨骨髓炎包括牙源性中央性颌骨骨髓炎、牙源性边缘性颌骨骨髓炎以及婴幼儿颌骨骨髓炎。非化脓性颌骨骨髓炎包弥漫性硬化性骨髓炎、Garré骨髓炎、颌骨放射性骨坏死、颌骨化学性骨坏死、特异性骨髓炎等。